土壤有机物在细菌、真菌、放线菌的作用下形成腐殖酸、木质素、蛋白质、脂肪的过程为
A. 硫化作用
B. 腐殖质化作用
C. 氨化作用
D. 亚硝化作用
E. 硝化作用

正确答案：B。腐殖质化作用

解析：本题考查腐殖质化作用。土壤有机物在细菌、真菌、放线菌的作用下形成腐殖酸、木质素、蛋白质、脂肪的过程为腐殖质化作用（B对ACDE错）。腐殖质化作用是土壤有机物的重要分解过程，是土壤有机物的转化过程，也是土壤有机物的重要组成部分。